骑跨性会阴部损伤易损伤尿道的部位是
A. 前列腺部
B. 球部
C. 膜部
D. 悬垂部
E. 尿道外口

正确答案：B。球部

解析：骑跨性会阴部损伤易损伤尿道球部（B对）。当发生骨盆骨折时，易损伤膜部（C错），严重者可引起前列腺部（A错）损伤。悬垂部（D错）和尿道外口（E错）损伤较少见。